下述哪个结构属锥体外系
A. 皮质脊髓束
B. 皮质核(脑干)束
C. 脊髓丘脑束
D. 红核脊髓束
E. 丘脑皮质束

正确答案：D。红核脊髓束

解析：锥体外系锥体系以外影响和控制躯体运动的所有传导路径，主要由皮质→纹状体→背侧丘脑→皮质环路和皮质→脑桥→小脑→皮质环路构成。包括红核脊髓束（D对）。